属于第二级预防措施的是
A. 遗传咨询
B. 疾病筛检
C. 病后康复
D. 健康促进
E. 疫苗接种

正确答案：B。疾病筛检

解析：第二级预防包括早期发现、早期诊断、早期治疗，其中早期发现疾病可通过普查、筛查（B对）、定期健康检查、高危人群重点项目检查及设立专科门诊等。遗传咨询（A错）、疫苗接种（E错）、健康促进（D错）是第一级预防中针对健康个体的措施。病后康复（C错）是第三级预防（P7）即对已患某些病者，采取及时的、有效的治疗措施，终止疾病的发展，防止病情恶化，预防并发症和伤残；对已丧失劳动力或伤残者，主要促使功能恢复、心理康复等。